颌面部创伤后组织水肿反应快而重的原因是颌面部
A. 血运丰富
B. 较早发生感染
C. 皮下脂肪丰富
D. 神经丰富且敏感
E. 处于暴露部位

正确答案：A。血运丰富

解析：本题考查颌面部创伤后组织水肿反应快而重的原因。由于口腔颌面部血液循环丰富，伤后出血较多，容易形成血肿；组织水肿反应快而重，如口底、舌根或下颌下等部位损伤，可因水肿、血肿压迫而影响呼吸道通畅，甚至引起窒息（A对）。易发生感染是颌面部损伤的特点之一（B错）。皮下脂肪丰富，水肿液形成缓慢，不会迅速引起水肿（C错）。神经丰富且敏感常引起疼痛（D错）。处于暴露部位易发生感染（E错）。